肺水肿防治原则是
A. 防止毒物继续侵入
B. 肾上腺皮质激素的应用，限制补液量，脱水、利尿
C. 维持呼吸道通畅
D. 兴奋呼吸中枢、支气管解痉、对症治疗等
E. 以上都是

正确答案：E。以上都是